胸主动脉，错误的描述是
A. 在胸骨角平面续自主动脉弓
B. 在第10胸椎高度穿膈的主动脉裂孔
C. 起始部居食管左侧
D. 经食管前方渐转至其右侧
E. 分支有壁支和脏支

正确答案：D。经食管前方渐转至其右侧

解析：胸主动脉在胸骨角平面续自主动脉弓（A对）。在第10胸椎高度穿膈的主动脉裂孔（B对）。初沿脊柱的左侧下行即起始部居食管左侧（C对）。逐渐转向其前方（D错，为本题正确答案）。分支有壁支和脏支（E对）。